呈不规则类圆形或条形厚片；切面黄白色或灰白色，散有多数棕红色或橙黄色油点，有的可析出白色细针状结晶的饮片是
A. 地榆
B. 苍术
C. 防风
D. 板蓝根
E. 木香

正确答案：B。苍术

解析：本题考查的是苍术的性状鉴别。呈不规则类圆形或条形厚片；切面黄白色或灰白色，散有多数棕红色或橙黄色油点，有的可析出白色细针状结晶的饮片是苍术（B对）。苍术【性状鉴别】饮片苍术：呈不规则类圆形或条形厚片，外表皮灰棕色至黄棕色，有皱纹，有时可见根痕。切面黄白色或灰白色，散有多数棕红色或橙黄色油点（油室），习称“朱砂点”，有的可析出白色细针状结晶。地榆（A错）【性状鉴别】饮片地榆：呈不规则的类圆形片或斜切片。外表皮灰褐色至深褐色。切面较平坦，粉红色、淡黄色或黄棕色，木部略呈放射状排列；或皮部有多数黄棕色绵状纤维。防风（C错）【性状鉴别】饮片为圆形或椭圆形厚片。外表皮灰棕色或棕褐色，有纵皱纹，有的可见横长皮孔样突起、密集的环纹或残存的毛状叶基。切面皮部棕黄色至棕色，有裂隙及细小油点，形成层环明显，木部浅黄色，具放射状纹理。板蓝根（D错）【性状鉴别】饮片呈圆形厚片。外表皮淡灰黄色至淡棕黄色，有纵皱纹。切面皮部黄白色，木部黄色。木香（E错）【性状鉴别】饮片木香：呈类圆形或不规则的厚片，外表皮黄棕色至灰褐色，有纵皱纹。切面棕黄色至棕褐色，中部有明显菊花心状的放射纹理，形成层环棕色，褐色油点（油室）散在。